杨某，45岁，胃脘胀闷，攻撑作痛，脘痛连胁，嗳气频繁，大便不畅，每因情志因素而痛作，苔多薄白，脉沉弦，治疗应选用
A. 柴胡疏肝散
B. 一贯煎合芍药甘草汤
C. 黄芪建中汤
D. 良附丸加味
E. 保和丸

正确答案：A。柴胡疏肝散

解析：肝主疏泄而喜条达，若情志不舒，则肝气郁结不得疏泄，横逆犯胃则胃脘胀闷；胁乃肝之分野，气多走窜游移，故见攻撑作痛，脘痛连胁；气滞不舒则嗳气频繁；气滞肠道，传导失常，故大便不畅；若情志不和，则肝郁更甚，气结复加，故每因情志因素而痛作；病在气分而湿浊不甚，则苔多薄白；病在里而肝主痛，故见脉沉弦，属于肝胃不和证；治疗需疏肝理气，和胃止痛，方药选用柴胡疏肝散加减（A对）。一贯煎合芍药甘草汤（B错）可以滋阴疏肝，和胃止痛，用于治疗阴虚肝郁证。黄芪建中汤（C错）可以健脾益气，温中和胃，用于治疗脾胃虚弱证。良附丸加味（D错）可以温胃理气，用于治疗寒凝气滞，脘痛吐酸，胸腹胀满。保和丸（E错）可以消食化积，用于治疗饮食积滞，胃脘不舒证。